清胆利湿,和胃化痰的方剂是
A. 青蒿鳖甲汤
B. 茵陈蒿汤
C. 半夏泻心汤
D. 四逆散
E. 蒿芩清胆汤

正确答案：E。蒿芩清胆汤

解析：清胆利湿,和胃化痰的方剂是蒿芩清胆汤，主治少阳湿热证，为治疗少阳湿热证的代表方（E对）。青蒿鳖甲汤功用养阴透热（A错）。茵陈蒿汤功用清热，利湿，退黄（B错）。半夏泻心汤功用寒热平调，消痞散结（C错）。四逆散功用透邪解郁，疏肝理脾（D错）。